患者静脉注射某药500mg（Xo），若其初始血药浓度（O）为25mg/L，则该药的表观分布容积（V）是
A. 15L
B. 20L
C. 25L
D. 30L
E. 35L

正确答案：B。20L

解析：本题考查的是常用的药物动力学参数表观分布容积的计算。患者静脉注射某药500mg（Xo），若其初始血药浓度（O）为25mg/L，则该药的表观分布容积（V）是20L（B对）。表观分布容积（V）：表观分布容积是体内药量与血药浓度间关系的一个比例常数，用V表示。V=X/C。式中，V——表观分布容积；C——血药浓度。表观分布容积的单位通常以“L”或“L/kg”表示。由题可知：X=500mg，C=25mg/L，故V=X/C=500mg/25mg/L=20L。